男孩，2岁。因颜面及四肢凹陷性水肿1周来诊。查体BP85/55mmHg，尿蛋白（+++），RBC1～2/HP，血浆总蛋白40g/L，白蛋白20g/L，胆固醇6.2mmol/L，尿素氮5.5mmol/L，最可能的诊断是
A. 单纯性肾病综合征
B. 急进性肾小球肾炎
C. IgA肾病
D. 肾炎型肾病综合征
E. 急性肾小球肾炎

正确答案：A。单纯性肾病综合征

解析：患儿血白蛋白20g/L（﹤30g/L），可判断为肾病综合征。肾病综合征可以分为两类单纯性肾病和肾炎性肾病，由于该患儿并没有血尿以高血压的症状，应诊断为单纯性性肾病综合征（A对D错），而不是肾炎性肾病（单纯性肾病没有血尿、高血压等表现）。急进性肾炎很少见于儿童，一般表现为短时间内肾功能急剧下降，因此急进性肾炎不符合题意（B错）。IgA肾病一般仅有血尿的症状，很少会有高血压和血肿的症状（C错）。急性肾小球肾炎的血白蛋白正常，而该患儿白蛋白20g/L（低于正常），因此不能诊断为急性肾小球肾炎（E错）。